7月女婴，近1周易激惹，烦躁不安，呕吐2次，大便稀，2次/日，查体：嗜睡，前囟膨隆，有张力，颈强（+/-），心肺正常，布什征（+），巴氏征（+/-），为明确诊断，应做哪项检查
A. 脑电图
B. 脑CT
C. 脑脊液检查
D. PPD试验
E. X线胸片

正确答案：C。脑脊液检查

解析：7月女婴，近1周易激惹，烦躁不安，呕吐2次，大便稀，2次/日，查体：嗜睡，前囪膨，有张力，颈强（+/-），心肺正常，布什征（+），巴氏征（+/-）等表现高度怀疑化脓性脑膜炎，而脑脊液检查（C对）是确诊本病的重要依据，典型病例表现为压力增加，外观浑浊似米汤样。白细胞总数显著增多，≥1000×10⁶/L，糖含量常有明显降低，蛋白含量显著增高等。而脑电图检查（A错）常用于癫痫等大脑疾病的辅助诊断，脑CT（B错）常对新鲜出血较敏感，故常用于头颅外伤的辅助检查，亦可显示颅内肿瘤的数目、部位及大小等。PPD试验（P217）（D错）属于迟发型变态反应，硬结平均直径不足5mm为阴性，5～9mm为阳性，10～19mm为中度阳性，≥20mm为强阳性，局部除硬结外，还有水肿、破溃、淋巴管炎及双圈反应等为极强阳性，常用于检验是否感染结核菌或接种卡介苗等。X线胸片（E错）多用于肺部疾病的辅助检查，可检出肺部疾病的病灶范围、性质、类型等，操作简单且较为便宜，可重复进行。